女，45岁。近一年来盗汗、心悸、易怒，食量增加。检查：突眼，心率110次/分，血压126/84mmHg，甲状腺弥漫性肿大Ⅲ°，心律齐、无杂音，举手颤动明显。查血T₃、T₄高于正常值。诊为原发性甲亢，经抗甲状腺药物治疗后复发，拟行甲状腺双侧次全切除术。若术后发生甲状腺功能减退，其诊断的主要依据是
A. 四肢乏力、盗汗
B. 食欲下降或厌食
C. 颈部皮肤浮肿
D. B超示残余甲状腺内结节性肿大
E. T₃、T₄值持续低于正常值下限

正确答案：E。T₃、T₄值持续低于正常值下限

解析：甲状腺功能减退的诊断除症状及体征外，必须有血T3、T4和TSH测定的依据。T3、T4值持续低于正常值下限（E对）表明体内甲状腺激素的合成、分泌不足，可作为诊断甲状腺功能减退的主要依据。甲状腺功能减退可表现为食欲下降或厌食（B错）、颈部皮肤浮肿（C错），但这些临床表现缺乏特异性，不能作为诊断的主要依据。B超为影像学检查手段，仅能够反映甲状腺形态及毗邻关系，不能了解甲状腺功能，因此B超示残余甲状腺内结节性肿大（D错）不作为诊断的主要依据。甲状腺功能减退一般不出现四肢乏力、盗汗（A错）症状，四肢乏力、盗汗多见于结核病患者。